25岁初产妇，妊娠39周，阵发性腹痛20小时，10～12分钟宫缩一次，持续30秒，宫口开大2cm。出现上述临床表现的原因是
A. 子宫收缩对称性异常
B. 子宫收缩节律性异常
C. 子宫收缩极性异常
D. 子宫收缩缩复作用异常
E. 腹肌和膈肌收缩力异常

正确答案：B。子宫收缩节律性异常

解析：本例宫缩持续时间短（＜30秒），间歇期长（＞5～6分钟），为子宫收缩节律异常（B对）。子宫收缩的对称性（P170）（A错）是指宫缩源于两侧宫角部，以微波形式向宫底中线集中，左右对称，向子宫下段扩散，均匀协调地扩散至整个子宫，本例没有提及对称性。宫缩以宫底部最强最持久，向下依次减弱，此为子宫收缩的极性（P170）（C错），本例与极性无关。宫缩时，肌纤维缩短变宽，间歇期不能恢复至原长度，经反复收缩，肌纤维越来越短，使宫腔的容积逐渐缩小，迫使胎先露下降和宫颈管的变短，此为缩复作用（P170）（D错），本例与缩复作用无关。腹肌和膈肌收缩力（P170）（E错）是第二产程胎儿娩出时的重要辅助力量，本题未达第二产程。